关于氟牙症的临床表现错误的是
A. 多见于恒牙，若发生于乳牙，程度亦轻
B. 白垩色斑、云雾状，其分布与釉质生长线不相吻合
C. 对摩擦耐受性差
D. 对酸蚀抵抗力弱
E. 严重的慢性氟中毒者，可有骨骼的增殖性变化

正确答案：D。对酸蚀抵抗力弱

解析：本题考查氟牙症的临床表现。关于氟牙症的临床表现错误的是对酸蚀抵抗力弱（D错，为本题的正确答案）。由于胎盘对氟有一定的屏障作用，氟牙症多见于恒牙，若发生在乳牙，程度亦较轻（A对）。氟牙症为长期性的损伤，斑块边界不明确，呈散在的云雾状与生长发育线不相吻合（B对）。当氟浓度过高时，可抑制碱性磷酸酶的活性，从而造成釉质发育不良、矿化不全，对摩擦耐受性差（C对）。由于血钙与氟结合，可形成不溶性的氟化钙，对酸蚀抵抗力强。严重的慢性氟中毒患者，可有骨骼的增殖性变化，骨膜、韧带等均可钙化（E对）。